注射液空安瓿的干燥宜采用
A. 冷冻干燥
B. 喷雾干燥
C. 减压干燥
D. 红外干燥
E. 沸腾干燥

正确答案：D。红外干燥